当归苦参丸除燥湿清热外，又能
A. 活血化瘀
B. 清热凉血
C. 散结消肿
D. 凉血利湿
E. 清热除湿

正确答案：A。活血化瘀

解析：本题考查的是当归苦参丸的功能。当归苦参丸除燥湿清热外，又能活血化瘀（A对）。当归苦参丸：【功能】活血化瘀，燥湿清热。消银颗粒：【功能】清热凉血（B错），养血润肤，祛风止痒。小金丸：【功能】散结消肿（C错），化瘀止痛。北刘寄奴：【功效】活血祛瘀，通经止痛，凉血止血，清热利湿（D错）。消风止痒颗粒：【功能】清热除湿（E错），消风止痒。